下列试验中不属于基因突变试验的是
A. Ames试验
B. 大肠杆菌回复突变试验
C. 哺乳动物细胞正向突变试验
D. 枯草杆菌DNA修复试验
E. 果蝇伴性隐性致死突变试验

正确答案：D。枯草杆菌DNA修复试验